三叉神经感觉功能检查时痛觉与温度觉均丧失而触觉存在，则可能
A. 腭后神经损害
B. 蝶腭神经损害
C. 上颌神经
D. 脊束核损害
E. 运动支损害

正确答案：D。脊束核损害

解析：在对三叉神经感觉功能检查时，如痛觉与温度觉均丧失而触觉存在时，可能是脊束核损害。掌握“三叉神经痛”知识点。